医患关系的传统模式是
A. 从传统的生物医学模式中派生出来的
B. 从传统的心理社会医学模式中派生出来的
C. 从传统的生物心理医学模式中派生出来的
D. 从传统的生物心理社会医学模式中派生出来的
E. 以上都不是

正确答案：A。从传统的生物医学模式中派生出来的

解析：传统模式这种模式是从传统的生物医学模式中派生出来的。在医疗活动中医生所关心的只是疾病的处理、科学知识的解释以及标准技术和常规技能的应用，很少考虑病人的期望和感受。医生对病人保持情感上的“立”，而病人则被动地服从医生的判断与决策。掌握“医患沟通的理论、技术与其应用以及医患关系模式”知识点。